阑尾最常发生的肿瘤是
A. 淋巴瘤
B. 平滑肌瘤
C. 类癌
D. 腺癌
E. 纤维肉瘤

正确答案：C。类癌

解析：阑尾肿瘤非常少见，主要包括类癌、腺癌和囊性肿瘤三种。阑尾类癌（C对）是阑尾最常发生的肿瘤，约占阑尾肿瘤的90%，也是胃肠道类癌中最常见的一种。